妊娠期使用某些药物可能导致胎儿发育异常，其中最易受到药物影响，可能产生形态或者功能上异常而造成胎儿畸形的阶段是
A. 妊娠1～2周
B. 妊娠3～12周
C. 妊娠13～27周
D. 妊娠28～32周
E. 妊娠33～40周

正确答案：B。妊娠3～12周

解析：本题考查妊娠期妇女用药。受精后3周～12周（B对）是胚胎和脏器的分化关键时期，此阶段极易受到药物影响，可能产生形态或功能上的异常，造成畸形。根据妊娠各阶段的特点，一般将妊娠分为3个阶段：妊娠头3个月，即妊娠12周末之前称为妊娠早期；妊娠中期的4个月，即妊娠13-27周末，称妊娠中期；妊娠最后3个月，即妊娠28周之后，称妊娠晚期。妊娠早期是胚胎器官和脏器的分化时期，最易受外来药物的影响引起胎儿畸形。妊娠中期和妊娠晚期又称胎儿形成期，为胎儿发育的最后阶段，器官形成过程已经大体完成并继续发育，某些药物可导致胎儿发育异常。